女，60岁。上腹胀痛伴恶心。呕吐2天，右下腹痛阵发加剧、腹胀半天。查体：T38.3℃，P120次/分，BP150/90mmHg，全腹压痛（+），右下腹明显，有肌紧张，肝浊音界存在，未闻及肠鸣音。实验室检查：WBC13.0×10⁹/L，N0.88。右下腹穿刺抽出黄色混浊液体2ml，镜检脓细胞（++）。最可能的诊断是
A. 重症急性胰腺炎
B. 绞窄性肠梗阻
C. 阑尾炎穿孔并弥漫性性腹膜炎
D. 消化性溃疡穿孔并弥漫性腹膜炎
E. 伤寒肠穿孔并弥漫性腹膜炎

正确答案：C。阑尾炎穿孔并弥漫性性腹膜炎

解析：老年女性患者，上腹胀痛伴恶心、呕吐2天，右下腹痛阵发加剧、腹胀半天，全腹压痛（+），右下腹明显（提示病变位于右下腹），有肌紧张，未闻及肠鸣音（腹膜刺激征象，提示弥漫性腹膜炎），肝浊音界存在，右下腹穿刺抽出黄色混浊液体2ml，镜检脓细胞（++）（可排除消化性溃疡穿孔），结合患者病史、体查和辅助检查，最可能的诊断为阑尾炎穿孔并弥漫性性腹膜炎（C对）。重症急性胰腺炎（A错）常在饱餐或饮酒后发作，表现为突发的剧烈上腹部疼痛，疼痛多位于左上腹，向左肩及左腰背部放射，伴恶心、呕吐、腹膜刺激征，腹腔穿刺可抽出血性渗出液。绞窄性肠梗阻（B错）腹痛发作急骤，呈持续性剧烈疼痛，腹胀不对称，呕吐早而频繁，病情发展快，早期便出现休克症状，腹腔穿刺抽出血性液体。消化性溃疡穿孔（D错）发病急骤，常表现为突发的上腹部刀割样疼痛，叩诊肝浊音界缩小或消失。伤寒肠穿孔（P356）（E错）见于已确诊为伤寒的病人，表现为突然发生的右下腹痛，短时间内扩散至全腹，伴有呕吐、腹胀、脉快、体温下降等。